患者，冠心病史3年。胸痛彻背，心痛如绞，胸闷憋气，形寒畏冷，四肢不温，冷汗自出，心悸气短，舌质紫暗，苔薄白，脉沉细或沉紧。其证型是
A. 冠心病心绞痛，阴寒凝滞证
B. 冠心病心绞痛，气阴两虚证
C. 冠心病心绞痛，寒痰痹阻证
D. 急性心肌梗死，痰瘀痹阻证
E. 急性心肌梗死，寒凝心脉证

正确答案：E。急性心肌梗死，寒凝心脉证

解析：诸阳受气于胸中而转行于背，寒邪内侵致阳气不运，气机痹阻，故见胸痛彻背，心痛如绞，胸闷憋气；阳气不足，机体失于温煦故见形寒畏冷，四肢不温，冷汗自出；胸阳不振，气机受阻，故见心悸气短；舌质紫暗，苔薄白，脉沉细或沉紧，均为阴寒凝滞，阳气不运的表现；可以诊断为急性心肌梗死，寒凝心脉证（E对）。患者胸痛彻背，心痛如绞，疼痛程度严重，故不是心绞痛（ABC错）。急性心肌梗死，痰瘀痹阻证（D错）的特点为胸痛剧烈，如割如刺，胸闷如窒，气短痰多，心悸不宁，腹胀纳呆，恶心呕吐。